某中年男患者因心脏病发作被送到急诊室，症状及检查结果均明确提示心肌梗死。患者很清醒，但拒绝住院，坚持要回家。此时医生应该
A. 尊重患者自主权，自己无任何责任，同意他回家
B. 尊重患者自主权，但应尽力劝导患者住院，无效时办好相关手续
C. 尊重患者自主权，但应尽力劝导患者住院，无效时行使干涉权
D. 行使医生自主权，为治救病人，强行把患者留在医院
E. 行使家长权，为治病救人，强行把患者留在医院

正确答案：C。尊重患者自主权，但应尽力劝导患者住院，无效时行使干涉权